膜性口炎是由
A. 梭螺杆菌引起
B. 分枝杆菌引起
C. 柯萨奇病毒M引起
D. Ⅰ型单纯疱疹病毒引起
E. 金黄色葡萄球菌和溶血性链球菌引起

正确答案：E。金黄色葡萄球菌和溶血性链球菌引起

解析：本题考查球菌性口炎的病因。口腔黏膜球菌感染即膜性口炎往往是几种球菌同时致病，引起口腔黏膜的急性损害，主要致病菌有金黄色葡萄球菌、草绿色链球菌、溶血性链球菌、肺炎双球菌等（E对）。梭螺杆菌和螺旋体的感染可引起急性坏死溃疡性牙龈炎（A错）。柯萨奇病毒A16感染可引起手足口病（C错）。Ⅰ型单纯疱疹病毒感染可引起疱疹（D错）。口腔结核是由结核分枝杆菌侵犯黏膜引起的慢性感染，所以分枝杆菌不能引起膜性口炎（B错）。